小便不甚赤涩，淋沥不尽，腰膝酸软证属
A. 热淋
B. 石淋
C. 劳淋
D. 血淋
E. 膏淋

正确答案：C。劳淋

解析：本题考查的是淋证的辨证论治。小便不甚赤涩，淋沥不尽，腰膝酸软证属劳淋（C对）。淋证是指以小便频数短涩，淋沥刺痛，小腹拘急引痛为主症的疾病。西医学的泌尿系感染、尿路结石、前列腺炎、尿道综合征等病，具有淋证表现特征者，可参考此内容辨证论治。（一）热淋（A错）：【症状】小便频数短涩，灼热刺痛，尿色黄赤，少腹拘急胀痛，或有寒热，口苦，呕恶，或腰痛拒按，或大便秘结。舌质红，苔黄腻，脉滑数。（二）石淋（B错）：【症状】尿中夹有砂石，排尿涩痛，或排尿时突然中断，尿道窘迫疼痛，少腹拘急，往往突发一侧腰腹绞痛难忍，甚则牵及外阴，尿中带血。舌质红，苔薄黄，脉弦或弦数。（三）血淋（D错）：【症状】小便热涩刺痛，尿色深红，或夹有血块，疼痛满急加剧，或见心烦。舌尖红，舌苔黄，脉滑数。（四）气淋：【症状】郁怒之后，小便涩滞，淋沥不宣，少腹胀满疼痛。舌苔薄白，脉弦。（五）膏淋（E错）：【症状】小便浑浊，乳白或如米泔水，上有浮油，置之沉淀，或伴有絮状凝块物，或混有血液、血块，尿道热涩疼痛，尿时阻塞不畅，口干。舌质红，苔黄腻，脉濡数。（六）劳淋：【症状】小便不甚赤涩，溺痛不甚，但淋沥不已，时作时止，遇劳即发，腰膝酸软，神疲乏力，病程缠绵。舌质淡，脉细弱。